根据《中华人民共和国药品管理法》，下列对违法行为的处罚错误的是
A. 医疗机构配制制剂为假药，情节严重的，吊销其《医疗机构制剂许可证》
B. 医疗机构配制制剂为劣药，情节严重的，吊销其《医疗机构制剂许可证》
C. 医疗机构将其配制的制剂在市场上销售的，吊销其《医疗机构制剂许可证》
D. 未取得《医疗机构制剂许可证》配制制剂的，没收违法生产的制剂和违法所得，并处罚款
E. 医疗机构从无《药品经营许可证》的企业购进药品，情节严重的，吊销其医疗机构执业许可证书

正确答案：C。医疗机构将其配制的制剂在市场上销售的，吊销其《医疗机构制剂许可证》

解析：本题考查违反《中华人民共和国药品管理法》的法律责任。根据《中华人民共和国药品管理法》，下列对违法行为的处罚错误的是医疗机构将其配制的制剂在市场上销售的，吊销其《医疗机构制剂许可证》（C错，为本题正确答案）。《中华人民共和国药品管理法》第一百三十三条规定，违反本法规定，医疗机构将其配制的制剂在市场上销售的，责令改正，没收违法销售的制剂和违法所得，并处违法销售制剂货值金额二倍以上五倍以下的罚款；情节严重的，并处货值金额五倍以上十五倍以下的罚款；货值金额不足五万元的，按五万元计算。生产、销售假药的，没收违法生产、销售的药品和违法所得，责令停产停业整顿，吊销药品批准证明文件，并处违法生产、销售的药品货值金额十五倍以上三十倍以下的罚款；货值金额不足十万元的，按十万元计算；情节严重的，吊销药品生产许可证、药品经营许可证或者医疗机构制剂许可证（A对），十年内不受理其相应申请；药品上市许可持有人为境外企业的，十年内禁止其药品进口。生产、销售劣药的，没收违法生产、销售的药品和违法所得，并处违法生产、销售的药品货值金额十倍以上二十倍以下的罚款；违法生产、批发的药品货值金额不足十万元的，按十万元计算，违法零售的药品货值金额不足一万元的，按一万元计算；情节严重的，责令停产停业整顿直至吊销药品批准证明文件、药品生产许可证、药品经营许可证或者医疗机构制剂许可证（B对）。未取得药品生产许可证、药品经营许可证或者医疗机构制剂许可证生产、销售药品的，责令关闭，没收违法生产、销售的药品和违法所得，并处违法生产、销售的药品（包括已售出和未售出的药品，下同）货值金额十五倍以上三十倍以下的罚款；货值金额不足十万元的，按十万元计算（D对）。